女性，25岁，低热，便秘腹泻交替3年，查：右下腹5cm×5cm肿块，质中等，较固定，轻压痛。最具诊断意义的检查是
A. 血沉
B. 血常规
C. 结肠镜检查
D. X线钡剂透视
E. 诊断性腹腔穿刺

正确答案：C。结肠镜检查

解析：青年女性患者，便秘腹泻交替3年，右下腹肿块，提示患者结肠病变。对结肠疾病的诊断最具价值的是结肠镜（C对），其可直接观察病灶的形态，并可在直视下做活检，以确定诊断。血沉（A错）增高可见于多种疾病，如急性炎症、白血病、结缔组织病及结核病的活动期，不具有特异性，不能诊断结肠疾病。血常规（B错）可用于鉴别患者的发热原因，但对结肠疾病的诊断没有价值。X线钡剂透视（D错）是诊断结肠疾病的次选检查，效果逊于结肠镜。诊断性腹腔穿刺（E错）用于腹腔积液、腹腔内出血等疾病，不用于肠结核的诊断。